每日容许摄入量（ADI）指的是
A. 允许正常成人每日由外环境摄入体内的化学物质的总量。
B. 允许正常成人每日由体内合成的化学物质的总量。
C. 允许正常成人每日由外环境摄入体内的有效营养物质的量。
D. 允许正常成人每日由体内合成的有效营养物质的量。

正确答案：A。允许正常成人每日由外环境摄入体内的化学物质的总量。

解析：本题考查每日容许摄入量（ADI）。每日容许摄入量（ADI）指的是允许正常成人每日由外环境摄入体内的化学物质的总量（A对BCD错）。